肾上腺素不具有下列哪种作用
A. 心肌收缩力增强
B. 心率加快
C. 内脏、皮肤血管收缩
D. 骨骼肌血管舒张
E. 组织液生成减少

正确答案：E。组织液生成减少